国家对病原微生物进行分类的根据之一是病原微生物的
A. 传播风险
B. 传染性
C. 严重程度
D. 危害程度
E. 高致病性

正确答案：B。传染性